患者，男，25岁，根尖周肉芽肿在拔牙后未作适当处理仍残留在颌骨内而发生的囊肿。拟诊断为
A. 含牙囊肿
B. 残余囊肿
C. 根端囊肿
D. 始基囊肿
E. 根尖周囊肿

正确答案：B。残余囊肿

解析：本题考查牙源性颌骨囊肿。根端囊肿是由于根尖周肉芽肿，慢性炎症的刺激，引起牙周膜内的上皮残余增生。增生的上皮团中央发生变性与液化，周围组织液不断渗出，逐渐形成囊肿，故亦可称根尖周囊肿。如果根尖周肉芽肿在拔牙后未作适当处理仍残留在颌骨内而发生的囊肿，则称为残余囊肿（B对）。残余囊肿在拔牙后的牙槽窝下方颌骨内出现圆形囊性密度减低影像。